婴儿出生后开始合成IgA在
A. 1～3个月
B. 2～4个月
C. 3～5个月
D. 4～6个月
E. 6个月以后

正确答案：D。4～6个月

解析：婴儿出生后4～6个月开始合成IgA。新生儿易患呼吸、胃肠道感染与其IgA合成不足有关。婴儿可从母亲初乳中获得SIgA，以抵抗呼吸道和消化道的病原体。掌握“各类球蛋白的特性和功能”知识点。